关于女性生殖道的生理防御机制，正确的是
A. 正常阴道菌群中不包括支原体和念珠菌
B. 卵巢分泌的孕激素使阴道上皮增厚并富含糖原
C. 宫颈内口紧闭以及宫颈管有黏液栓利于防止上行感染
D. 阴道正常情况下呈弱碱性环境
E. 宫颈阴道部表面为单层鱗状上皮，抗感染能力强

正确答案：C。宫颈内口紧闭以及宫颈管有黏液栓利于防止上行感染

解析：正常情况下，紧闭的宫颈内口以及宫颈管黏膜分泌所形成的胶冻状黏液栓的存在，有利于预防生殖道上行感染（C对）。支原体（A错）属于阴道正常菌群，雌激素（非孕激素）（B错）使阴道上皮增生变厚并增加细胞内糖原含量，阴道乳杆菌将单糖分解为乳酸，维持阴道正常的酸性环境（D错），子宫颈阴道部由非角化复层鳞状上皮覆盖（E错）。